因含寻骨风，肾功能不全患者禁用的中成药是
A. 九味羌活丸
B. 风湿定片
C. 痹痛宁胶囊
D. 腰痹通胶囊
E. 益肾蠲痹丸

正确答案：E。益肾蠲痹丸

解析：本题考查的是痹证的辨证论治。因含寻骨风，肾功能不全患者禁用的中成药是益肾蠲痹丸（E对）。痹证：（一）行痹：【中成药应用】合理用药与用药指导：孕妇、肾脏病患者禁用九味羌活丸（A错）。风热感冒或湿热证慎用九味羌活丸。因含有细辛，九味羌活丸不宜长期使用，服用期间定期复查肾功能。（二）痛痹：【中成药应用】合理用药与用药指导：（1）孕妇禁用风湿定片（B错）、寒湿痹颗粒；风湿热痹者，儿童、老弱者及合并心脏病患者慎用风湿定片、寒湿痹颗粒。运动员慎用寒湿痹颗粒。（2）不建议将寒湿痹颗粒与小活络丸、木瓜丸、风湿骨痛丸同时使用，均含有毒中药制川乌，属于重复用药。（三）着痹：【中成药应用】合理用药与用药指导：（1）风湿痹康胶囊、痹痛宁胶囊（C错）用于寒湿阻络所致的痹证；四妙丸、湿热痹痛颗粒用于湿热阻络所致的痹证。（2）孕妇禁用风湿痹康胶囊、痹痛宁胶囊和湿热痹颗粒；慎用四妙丸。风湿热痹者、脾胃虚弱者慎用风湿痹康胶囊和痹痛宁胶囊；寒湿痹、脾胃虚寒者慎用四妙丸、湿热痹颗粒。急慢性肝炎、急慢性肾炎患者慎用风湿痹康胶囊。高血压、心脏病、肝肾功能不全、癫痫、破伤风、甲亢者慎用痹痛宁胶囊。儿童、老年体弱者、运动员慎用风湿痹康胶囊、痹痛宁胶囊。风湿痹康胶囊、痹痛宁胶囊因含马钱子，不可过量、久用。（3）不建议将风湿痹康胶囊和痹痛宁胶囊同时使用，因都含有毒中药马钱子，容易导致毒性反应。不建议将湿热痹颗粒与四妙丸同用，因属重复用药。（四）尪痹：【中成药应用】合理用药与用药指导：（1）孕妇禁用独活寄生合剂、尪痹颗粒和益肾蠲痹丸；慎用天麻丸。肾蠲痹丸因含有寻骨风，肾功能不全者慎用。湿热痹者慎用独活寄生合剂、尪痹颗粒、天麻丸和益肾蠲痹丸。（2）不建议将天麻丸、尪痹颗粒与寒湿痹颗粒同时使用，均含有毒中药附子，属重复用药。瘀血腰痛：【中成药应用】合理用药与用药指导：孕妇禁用瘀血痹颗粒、舒筋活血定痛散、腰疼丸、腰痹通胶囊（D错）。高血压、动脉硬化、肝肾功能不全、癫痫、破伤风、甲亢病人禁用瘀血痹颗粒。脾胃虚弱者、月经过多者及出血性溃疡者慎用瘀血痹颗粒。阴虚火旺者慎用腰疼丸。脾虚便溏者慎用腰痹通胶囊。